在病例对照研究的资料分析阶段，最常用的控制混杂因素的方法是
A. 匹配
B. 标准化
C. 多元回归分析
D. 分层分析
E. 遵守随机化原则

正确答案：D。分层分析

解析：本题考查病例对照研究中控制混杂因素的方法。病例对照研究资料分析的中心内容是比较病例与对照中暴露的比例，并由此估计暴露与疾病之间是否有关联及其关联强度；也可进一步分析暴露与疾病的剂量反应关系等；可通过分层分析（D对ABCE错）、多因素分析控制混杂偏倚对研究结果的影响。